采取异病同治方法的原因是
A. 疾病不同
B. 症状相同
C. 证候相同
D. 阶段不同
E. 体征不同

正确答案：C。证候相同

解析：异病同治，指几种不同的疾病，在其发展变化过程中出现了大致相同的病机，表现为大致相同的证（C对），因而采用大致相同的治法和方药来治疗。如胃下垂、肾下垂、子宫脱垂、脱肛等不同的病变，其病机的关键是“中气下陷”，可表现为大致相同的证，故皆可用补益中气的方法来治疗。